男性，41岁。上腹疼痛7小时。伴发热，体温38.5℃，频繁呕吐。查体发现上腹部肌紧张，压痛，无移动性浊音。血白细胞15×10⁹/L。X线检查：膈下未见游离气体。治疗的基本措施是
A. 急诊手术
B. 禁食和胃肠减压
C. 腹腔穿刺引流
D. 腹腔镜切除胆囊
E. 应用大量广谱抗生素

正确答案：B。禁食和胃肠减压

解析：中年男性患者，上腹痛7小时、伴发热、频繁呕吐（急性胰腺炎常见的症状）。查体：上腹部肌紧张、压痛（腹膜刺激征）。血白细胞15×10⁹/L（正常为4～10×10⁹/L，提示有炎症）。X线检查：膈下未见游离气体（排除消化道穿孔）。综合患者的病史、查体、实验室检查，可初步诊断为急性胰腺炎。急性胰腺炎患者的治疗应在禁食和胃肠减压（B对）减少胰液分泌的基础上尽可能采取内科及内镜治疗。急诊手术（A错）创伤较大，会加重患者的全身炎症反应，增加死亡率。如诊断为胆源性急性胰腺炎，宜尽可能在本次住院期间完成内镜治疗或在康复后择期行胆囊切除术（D错），避免今后复发。患者无移动性浊音，无需腹腔穿刺引流（C错）。单纯急性胰腺炎无需抗生素治疗（E错），仅在胰腺感染后选用针对来自肠道的革兰阴性菌和厌氧菌的抗生素进行治疗。